性发育迟缓防治
A. 指超过正常青春期开始平均年龄2.5个标准差以上尚无性成熟发育者
B. 分为体质性延迟、低促性腺激素性腺功能延迟、高促性腺激素性腺技能减退
C. 重视心理疏导，积极防治全身慢性病，改善营养状况
D. 患有中枢神经系统或卵巢肿瘤者，可用性激素替代疗法
E. 年龄达12岁尚无月经来潮、无第二性征发有称性发育迟缓

正确答案：C。重视心理疏导，积极防治全身慢性病，改善营养状况

解析：本题考查性发育迟缓的防治。性发育迟缓的防治重视心理疏导，防止精神发育受限；积极防治全身慢性病，干预越早，康复治疗效果越好；改善营养状况，培养良好的饮食习惯，多吃富含各类营养的食物（C对ABDE错）。